种植后牙周维护治疗包括
A. 定期复诊
B. 定期洁治
C. 保持良好口腔卫生
D. 抗菌药物含漱或龈下冲洗
E. 以上均对

正确答案：E。以上均对

解析：本题考查种植后牙周维护治疗。牙周病患者在完成种植治疗之后，必须规律地定期支持维护，其种植治疗后才能获得长期成功。因此，牙周炎患者种植后应定期复诊（A对），定期复诊中应包括：评价种植体及天然牙周围的软硬组织健康情况、种植体稳定性、修复体完整性和稳定性、患者口腔卫生控制能力和菌斑控制状况以及对种植体周和牙周组织的专业维护处理。种植治疗的长期成功依赖于种植体周围组织健康状态的维护，良好的口腔卫生和规律的专业维护种植体维护非常重要。进行口腔健康教育，教会患者掌握自我菌斑控制的方法，保持良好的口腔卫生（C对）。采用抗菌药物含漱或龈下冲洗（D对），可对菌斑的控制有一定效果。种植治疗完成后的第一年，应每3个月复查1次，以后间隔期逐渐延长，每隔6个月或12个月进行洁治治疗。综上，以上均对（E对，为本题正确答案）。